有关上腔静脉的描述，错误的是
A. 由颈内静脉和锁骨下静脉汇合而成
B. 注入右心房
C. 收纳上肢、头颈和胸壁的静脉血
D. 沿主动脉升部右缘垂直下降
E. 内含静脉血

正确答案：A。由颈内静脉和锁骨下静脉汇合而成

解析：上腔静脉由左、右头臂静脉（A错，为本题正确答案）汇合而成。注入右心房（B对）。收纳上肢、头颈和胸壁的静脉血（CE对）。沿升主动脉右侧下行（D对）。